疾病的发展取决于
A. 病因的数量与强度
B. 存在的诱因
C. 机体自稳调节的能力
D. 损伤与抗损伤力量的对比
E. 机体的抵抗力

正确答案：D。损伤与抗损伤力量的对比

解析：由于不同疾病中损伤与抗损伤反应的差异，构成了各种疾病的不同特征，所以疾病的发展取决于损伤与抗损伤力量的对比（D对）。